火毒结聚首选的方剂是
A. 清暑汤
B. 托里透毒散
C. 五味消毒饮合透脓散
D. 活血散瘀汤
E. 黄连解毒汤合犀角地黄汤

正确答案：C。五味消毒饮合透脓散

解析：火毒结聚证，证候：多见于体表感染，患部肿势高突，焮热灼痛，有波动感；舌红，苔黄，脉数。治法：清火解毒透脓，方药：五味消毒饮合透脓散加减（C对）。暑湿流注证，治法：清暑解毒化湿，方药：清暑汤（A错）。气血不足证，治法：消肿，溃脓，生肌，方药：托里透毒散（B错）。瘀血流注证，治法：和营祛瘀，清热化湿。方药：活血散瘀汤加减（D错）。余毒流注证，治法：清热解毒，凉血通络，方药：黄连解毒汤合犀角地黄汤加减（E错）。